对危及用药安全、有效、合理的处方拒绝调配，是
A. 执业药师的权力
B. 执业药师的义务
C. 执业药师的权利
D. 执业药师的执业行为规范
E. 执业药师的道德准则

正确答案：A。执业药师的权力